患儿，6岁。睡中经常遗尿，醒后方觉，神疲乏力，面色苍白，肢凉畏寒，腰腿痠软，小便清长，舌淡苔白。治疗应首选
A. 理中汤
B. 补中益气汤
C. 菟丝子散
D. 五苓散
E. 缩泉丸

正确答案：C。菟丝子散

解析：患儿，6岁。睡中经常遗尿，醒后方觉，诊断为小儿遗尿，神疲乏力，面色苍白，肢凉畏寒，腰腿痠软，小便清长，舌淡苔白，可辨证为肾气不足型，应选用菟丝子散温补肾阳，固涩膀胱（C对）。理中汤用于脾胃虚寒证（A错）。补中益气汤合缩泉丸用于脾肺气虚型遗尿（BE错）。五苓散温阳化气，利湿行水（D错）。